患者，男，78岁。患背部有头疽月余，局部疮形平塌，根盘散漫，疮色紫滞，溃后脓水稀少，伴有唇燥口干，便艰溲短，舌质红，脉细数。内治应首选
A. 仙方活命饮
B. 竹叶黄芪汤
C. 托里消毒散
D. 知柏地黄汤
E. 清骨散

正确答案：B。竹叶黄芪汤

解析：患者外感风温、湿热，内有脏腑蕴毒，内外邪毒互相搏结，凝聚肌肤，以致营卫不和，气血凝滞，经络阻隔而成有头疽。患者年老体衰，水亏火炽，故见局部疮形平塌，根盘散漫，疮色紫滞，溃后脓水稀少。阴虚失润故唇燥口干，便艰溲短，舌质红，脉细数亦为阴虚火炽证之象，故辨证为阴虚火炽证，治宜滋阴生津，清热托毒。方用竹叶黄芪汤加减（B对）。仙方活命饮可用于有头疽之湿热壅滞证（A错）。托里消毒散可用于肛漏之正虚邪恋证（C错）。知柏地黄汤可用于慢性前列腺炎之阴虚火旺证（D错）。清骨散合六味地黄丸用于流痰之阴虚内热证（E错）。